左心室压下降速率最快是在
A. 等容收缩期
B. 快速射血期
C. 减慢射血期
D. 等容舒张期
E. 快速充盈期

正确答案：D。等容舒张期